基因表达是指
A. 基因突变
B. 遗传密码的功能
C. mRNA合成后的修饰过程
D. 蛋白质合成后的修饰过程
E. 基因转录和翻译的过程

正确答案：E。基因转录和翻译的过程